发作性呼气性呼吸困难，临床最常见于
A. 气胸
B. 气管内异物
C. 急性支气管炎
D. 急性心肌梗死
E. 慢性阻塞性肺疾病

正确答案：E。慢性阻塞性肺疾病

解析：呼气性呼吸困难主要由肺泡弹性减低和（或）小支气管的炎症或痉挛所致。表现为呼气费力、呼气缓慢、呼气时间延长，常伴呼气期啸鸣音等。常见于慢支、慢阻肺（E对）、哮喘等。由于胸腔内积气引起肺呼吸面积减少导致换气功能障碍，因而气胸（A错）引起的呼吸困难属于混合性呼吸困难。气管内异物（B错）导致气道狭窄或阻塞，引起吸气困难，因而气道内异物引起的呼吸困难属于吸气性呼吸困难。急性支气管炎（C错）是由病毒、细菌等病原体感染所致的支气管黏膜炎症，疾病多累及气管、支气管，一般不诱发呼吸困难，继发气道阻塞时可引起吸气性呼吸困难。急性心肌梗死（D错）引起心力衰竭时引起的呼吸困难属于心源性呼吸困难。